诊断反流性食管炎最可靠的方法是
A. 胃镜
B. 食管滴酸试验
C. 食管钡剂X线检查
D. 食管测压
E. 24小时食管pH值监测

正确答案：A。胃镜

解析：胃镜（A对）是诊断反流性食管炎（RE）最准确的方法，并能判断反流性食管炎的严重程度和有无并发症（P348）。食管滴酸试验（B错）是通过使食管粘膜酸化来诱发患者的烧心，胸痛症状，以确定症状是否与酸敏感有关。食管钡剂X线检查（C错）对诊断RE敏感性不高，主要用于排除食管癌。食管测压（D错）可辅助诊断RE，并不是最可靠方法，价值不大。24小时食管pH值监测（E错）是诊断胃食管反流病（GERD）的重要方法，在胃镜阴性时采用（P348）。